大黄牡丹汤中配伍大黄的主要目的是
A. 泻热降火解毒
B. 泻热凉血止血
C. 泻热荡涤通便
D. 泻除湿热瘀结
E. 荡涤凝瘀败血

正确答案：D。泻除湿热瘀结

解析：大黄牡丹汤方含大黄、丹皮、桃仁、瓜子、芒硝，以泻热破瘀，散结消肿，主治湿热瘀滞之肠痈初起。其中大黄、桃仁相配破瘀泻热（D对），共为君药。芒硝咸寒，泻热导滞，软坚散结，助大黄以荡涤实热；牡丹皮辛苦微寒，凉血散瘀消肿，两药为臣。佐以冬瓜子能清肠中湿热，排脓散结消痈，以治肠痈。